非处方药分为甲类、乙类的依据是
A. 有效性
B. 安全性
C. 可及性
D. 稳定性
E. 经济性

正确答案：B。安全性

解析：经营处方药、非处方药的批发企业和经营处方药、甲类非处方药的零售企业，必须具有《药品经营许可证》。经省级药品监督管理部门或其授权的药品监督管理部门批准的其他商业企业，可以零售乙类非处方药。根据甲类和乙类非处方药的购买方式，可判断安全性（B对）是非处方药分为甲类、乙类的依据，而有效性、可及性、稳定性、经济性均不是非处方药分为甲类和乙类的依据（ACDE错）。